氢氯噻嗪阻断甲苯磺丁脲的促胰岛素分泌作用属于
A. 敏感化作用
B. 拮抗作用
C. 无关作用
D. 增加毒性
E. 增加疗效

正确答案：B。拮抗作用

解析：本题考查药物的相互作用。氢氯噻嗪可竞争性抑制甲苯磺丁脲对胰岛β细胞释放胰岛素的促进作用，降低甲苯磺丁脲的药效，属于拮抗作用（B对）。敏感化作用（A错）是指一种药物可使组织或受体对另一种药物的敏感性增强。无关作用（C错）最新版考试指南中未明确说明。增加毒性（D错）：氢溴酸山莨菪碱与哌替啶合用时可增加毒性。增加疗效（E错）：他巴唑坦抑制β-内酰胺酶使头孢噻肟免受破坏属于增加疗效。